感染病原微生物后，血清中最早出现的特异性免疫球蛋白是
A. IgM
B. IgD
C. IgG
D. IgA
E. IgE

正确答案：A。IgM

解析：本题考查各类免疫球蛋白的生物学特性和功能。感染病原微生物后，血清中最早出现的特异性免疫球蛋白是IgM（A对）。IgD（B错）占血清免疫球蛋白总量的0.2%，半衰期仅为3天。B细胞表面的膜结合型单体IgD（mIgD）为B细胞分化发育成熟的标志之一，也是BCR的组成成分。IgG（C错）是血清中含量最高的Ig，且是唯一能够通过胎盘进入胎儿体内的Ig，对防止新生儿感染具有重要意义。IgA（D错）有血清型和分泌型两类。血清型IgA主要存在于血清中，为单体；分泌型IgA（SIgA）为二聚体，SIgA为是外分泌液中的主要抗体成分，婴儿可从母亲初乳中获得。IgE（E错）是正常人血清中含量最少的Ig。